以下哪项是统计设计不包括的
A. 实验分组或抽样方法
B. 实验或观察方法
C. 样本含量估计
D. 数据处理与质量控制
E. 拟使用的统计分析方法

正确答案：B。实验或观察方法

解析：统计设计包括实验分组或抽样方法、样本含量估计、数据处理与质量控制、拟使用的统计分析方法等。掌握“统计基本概念和步骤”知识点。